月经的第1～4天，称为
A. 月经期
B. 增殖期
C. 分泌期
D. 分泌晚期
E. 月经周期

正确答案：A。月经期

解析：月经期：月经周期第1～4日。掌握“女性生殖系统生理”知识点。